我国的局部振动卫生标准可保护百分之几的作业工人20年（年接振250天，日接振2.5小时）不致发生振动性白指
A. 100%
B. 95%
C. 90%
D. 85%
E. 80%

正确答案：C。90%